选择性迷走神经切断术治疗十二指肠溃疡时加作幽门成形术的目的是
A. 进一步降低胃酸
B. 防止手术后腹泻
C. 减低溃疡复发率
D. 解除胃滞留
E. 有利于消化吸收功能

正确答案：D。解除胃滞留

解析：胃的运动和分泌主要受交感神经和迷走神经支配，迷走神经兴奋时胃的运动和分泌增强。左侧迷走神经在贲门腹侧面分出肝支和胃前支，右侧迷走神经在贲门背侧分出腹腔支和胃后支。胃前、后支至胃窦处的终末分支呈“鸦爪”状，控制胃窦的运动和排空。选择性迷走神经切断术切断了包括鸦爪支在内的胃的所有迷走神经支配，使胃蠕动减退、排空障碍，导致胃潴留，因此需加作幽门成形术，以解除胃潴留（D对）。胃酸的分泌主要受神经-体液因素的调节，附加幽门成形不会降低胃酸分泌（A错）。腹泻是迷走神经切断术的并发症之一，可能与肠转运时间缩短、肠吸收减少等因素有关，因而幽门成形术不能防止术后腹泻的发生（B错）。术后溃疡复发率（C错）与迷走神经切断是否彻底、迷走神经切断后的再生有关，食物的消化吸收（E错）与各种消化液的分泌量和小肠功能有关，而与附加幽门成形无关。八版外科学已删除迷走神经切断术有关内容。